导致生物地球化学性疾病防治工作复杂性的最主要原因是
A. 病区居民营养素摄入不足
B. 地球表面某种化学元素分布不均衡
C. 病区经济发展滞后
D. 同一地区多种病因元素并存
E. 病区居民有一些特殊的生活习惯

正确答案：D。同一地区多种病因元素并存

解析：本题考查导致生物地球化学性疾病防治工作复杂性的最主要原因。生物地球化学性疾病是由于地壳表面化学元素分布的不均匀性，使某些地区的水和（或）土壤中某些元素过多或过少，当地居民通过饮水、食物等途径摄入这些元素过多或过少，而引起某些特异性疾病。在生物地球化学性疾病的防治工作中发现，一些地区存在着两种或两种以上疾病（D对ABCE错），从而加重了防治工作的复杂性。